患者况某，男，26岁。发热数日，口干舌燥，大便困难，偶便少许秽浊稀水，恶臭难闻，脐腹疼痛，按之坚硬又快，脉滑实治宜选用
A. 大承气汤
B. 增液汤
C. 麻子仁丸
D. 济川煎
E. 黄龙汤

正确答案：A。大承气汤

解析：“患者发热数日，口干舌燥，大便困难，偶便少许秽浊稀水，恶臭难闻，脐腹疼痛，按之坚硬又快”乃热结旁流证的表现，实热燥屎结于肠胃，腑气不通，故发热、口干舌燥，大便困难，脐腹疼痛，按之坚硬有块；燥屎内结不出，迫肠中之津从旁而下，故偶便少许秽浊稀水；脉滑实乃实热积滞内结之象，故以大承气汤（A对），攻下实热，荡涤燥结。增液汤功用为增液润燥，主治阳明温病，津亏肠燥便秘证（B错）。麻子仁丸功用润肠泄热，行气通便，主治脾约证（C错）。济川煎功用为温肾益精，润肠通便，主治肾虚便秘（D错）。黄龙汤功用为泻下热结，益气养血，主治阳明腑实兼气血不足证（E错）。